乌头碱是川乌的主要化学成分之一，其结构类型属于
A. 吡啶类生物碱
B. 茛菪烷类生物碱
C. 吲哚类生物碱
D. 异喹啉类生物碱
E. 二萜类生物碱

正确答案：E。二萜类生物碱

解析：本题考查川乌中的主要毒性生物碱及其化学结构。川乌中的主要毒性生物碱及其化学结构乌头和附子主要含二萜类生物碱（E对），属于四环或五环二萜类衍生物。乌头生物碱的结构复杂、结构类型多。其重要和含量较高的有乌头碱、次乌头碱和新乌头碱。吡啶类生物碱（A错）此类生物碱多来源于赖氨酸，是由吡啶或哌啶衍生的生物碱，其结构简单，数量较少，主要有两种类型。（1）简单吡啶类此类生物碱分子较小，结构简单，很多呈液态。如槟榔中的槟榔碱、槟榔次碱，烟草中的烟碱，胡椒中的胡椒碱等。洋金花中的主要生物碱及其化学结构洋金花主要化学成分为莨菪烷类生物碱（B错），由莨菪醇类和芳香族有机酸结合生成的一元酯类化合物。吲哚类生物碱（C错）这类生物碱来源于色氨酸，其数目较多，结构复杂，多具有显著的生物活性。主要分布于马钱科、夹竹桃科、茜草科等。延胡索中的主要生物碱及其化学结构延胡索含有多种苄基异喹啉类生物碱（D错）。